两颧紫红，口唇发绀，多见于
A. 苦笑面容
B. 伤寒面容
C. 甲亢面容
D. 二尖瓣面容
E. 慢性病面容

正确答案：D。二尖瓣面容

解析：两颧紫红，口唇发绀，多见于二尖瓣面容（D对）。苦笑面容见于见于破伤风（A错）。伤寒面容即表情淡漠，反应迟钝，呈无欲状态。见于肠伤寒，脑脊髓膜炎，脑炎等高热衰竭患者（B错）。甲亢面容为消瘦，两眼球突出，兴奋不安，呈惊恐貌（C错）。慢性病面容即面容憔悴，面色灰暗或苍白，目光暗淡，神疲力乏等（E错）。